下课铃一响，几个校篮球队员便迫不及待地跑到操场上，分成两组，打起篮球。没打几分钟，周亮跳起投球，落地时摔倒了。好不容易站起来，右脚却不能动了，而且很痛。引起这次运动性损伤最主要的原因是
A. 场地不平整
B. 身体太疲劳
C. 准备活动不充分
D. 比赛缺乏组织
E. 训练水平低

正确答案：C。准备活动不充分